两臂酸痛或抽掣，不得上举，两手麻木，舌苔白腻，脉弦滑者，治宜选用
A. 茯苓丸
B. 定痫丸
C. 地黄饮子
D. 补阳还五汤
E. 独活寄生汤

正确答案：A。茯苓丸

解析：题中两臂酸痛或抽掣多为邪侵经络，结合舌苔白腻，脉弦滑可知为痰饮所致，而非风湿，为痰伏中脘，流注经络证。茯苓丸功能燥湿行气，软坚散结（A对）。定痫丸功能涤痰息风，开窍安神，主治风痰蕴热之痫病（B错）。地黄饮子功能滋肾阴，补肾阳，开窍化痰，主治下元虚衰，痰浊上泛之喑痱证（C错）。补阳还五汤功能补气，活血，通络，主治中风之气虚血瘀证（D错）。独活寄生汤功能祛风湿，止痹痛，益肝肾，补气血，主治痹证日久，肝肾两虚，气血不足证（E错）。